可用于治疗先兆流产和习惯性流产的药物是
A. 雌二醇
B. 他莫昔芬
C. 甲地孕酮
D. 米非司酮
E. 二甲双胍

正确答案：C。甲地孕酮

解析：本题考查甲地孕酮。甲地孕酮（C对）为天然孕激素孕酮，用于治疗不孕症、先兆性流产及习惯性流产。雌二醇（A错）用于功能性子宫出血、原发性闭经、绝经期综合征以及前列腺癌等。他莫昔芬（B错）用于治疗乳腺癌、化疗无效的晚期卵巢癌和晚期子宫内膜癌。米非司酮（D错）为紧急避孕药。二甲双胍（E错）首选用于单纯饮食控制及体育锻炼治疗无效的2型糖尿病，特别是肥胖的2型糖尿病。